在下列哪种情况下最容易触及心包摩擦感
A. 左仰卧位，胸骨左缘第2肋间处，深呼气末
B. 坐位前倾，胸骨左缘第4肋间处，深呼气末
C. 坐位前倾，胸骨左缘第4肋间处，深吸气末
D. 左侧卧位，胸骨左缘第2肋间处，深吸气末
E. 仰卧位，剑突下，屏住呼吸时

正确答案：B。坐位前倾，胸骨左缘第4肋间处，深呼气末

解析：心包摩擦感是由于急性心包炎时心包膜纤维素渗出致表面粗糙，心脏收缩时脏层与壁层心包摩擦产生的振动传至胸壁所致。最容易触及心包摩擦感的是坐位前倾，胸骨左缘第4肋间处，深呼气末（B对）。